患者，女，27岁，孕8周，身高168cm，体重58kg，因体检尿常规结果异常就诊，白细胞300/μl。今日尿培养回报：尿细菌计数2.13×10⁵cfu/ml，患者自述无尿频、尿急、尿痛，无肉眼可见血尿，无腰痛、寒战或发热。该患者一旦发生尿路感染，宜选用的抗菌药物是
A. 阿莫西林
B. 左氧氟沙星
C. 阿米卡星
D. 甲硝唑
E. 亚胺培南

正确答案：A。阿莫西林

解析：本题考查妊娠期无症状菌尿治疗。该患者一旦发生尿路感染，宜选用的抗菌药物是阿莫西林（A对）。妊娠期无症状菌尿是首个被明确与围产期不良结局密切相关的亚临床感染之一，其导致早产儿或低出生体重儿的概率增加20～30倍。建议在妊娠期前3个月每月行一次尿培养，一旦发生尿路感染，宜选用毒性小的抗菌药物（阿莫西林、呋喃妥因或头孢菌素类等）。